两样本比较秩和检验中，已知n₁=n₂，若两样本来自同一总体，则
A. 两组秩和相等
B. 两组秩次相同
C. 两组秩和相等的概率较大
D. 两组秩次排列相差悬殊
E. 两组秩和相等的概率较小

正确答案：C。两组秩和相等的概率较大